能透过血-胎屏障的抗体分子是
A. IgD
B. IgE
C. IgA
D. IgG
E. IgM

正确答案：D。IgG

解析：在人类，IgG（D对）是唯一能通过胎盘的免疫球蛋白。胎盘母体一侧的滋养层细胞表达一种IgG输送蛋白，称为新生Fc段受体（FcRn）。IgG可选择性与FcRn结合，从而转移到滋养层细胞内，并主动进入胎儿血液循环中。其他免疫球蛋白的Fc段无法与FcRn结合，故不能通过胎盘屏障。